医疗机构取消医师抗菌药物处方权的情形是
A. 开具抗菌药物处方牟取不正当利益
B. 发生抗菌药物不良事件
C. 出现开具抗菌药物超常处方3次以上且无正当理由
D. 因紧急情况越级使用抗菌药物
E. 使用的抗菌药物明显超出规定用量

正确答案：A。开具抗菌药物处方牟取不正当利益

解析：医师开具抗菌药物处方牟取不正当利益的，医疗机构应当取消其处方权（A对）。医师按照规定开具抗菌药物处方或者使用抗菌药物而发生抗菌药物不良事件（B错）的，不受处罚。医疗机构对出现开具抗菌药物超常处方3次以上且无正当理由（CE错）的医师提出警告，限制其特殊使用级抗菌药物处方权（P240）。因紧急情况越级使用抗菌药物（D错），医师不受处罚（P239）。